髋关节后脱位的常见体征是
A. 髋关节外旋
B. 髋关节伸直
C. 髋关节外展
D. 患肢延长
E. 大转子上移

正确答案：E。大转子上移

解析：髋关节后脱位的常见体征是大转子上移（E对）。髋关节外旋（A错）、髋关节外展（C错），是髋关节前脱位的表现。